患者，男，68岁。打哈欠后突然下颌不能闭合，流涎，下颌中线偏向一侧。选用最佳的治疗方法是
A. 全麻下手法复位
B. 局麻下手法复位
C. 颌间牵引复位
D. 口内法手法复位
E. 不做处理，自行恢复

正确答案：D。口内法手法复位

解析：颞下颌关节急性脱位后应及时复位，复位后应限制下颌运动。方法有口内法和口外法，必要时复位前可给镇静剂。若脱位时间较长，咀嚼肌发生痉挛，关节局部水肿、疼痛或患者不能配合，给手法复位造成困难。此时，宜先行局部热敷或行关节周围和咀嚼肌封闭后，再行复位。个别情况脱位时间较长，手法常复位无效，可使用全身麻醉，配合肌松弛剂进行复位。掌握“颞下颌关节脱位”知识点。